冠状窦开口于
A. 左心房
B. 右心房
C. 右心室
D. 肺静脉根部
E. 上腔静脉根部

正确答案：B。右心房

解析：右心房（B对）后部内壁光滑，无肌性隆起，内有冠状窦开口、上腔静脉开口和下腔静脉开口。